从耳后，入耳中……至目外眦之下的经脉是
A. 足太阳膀胱经
B. 足阳明胃经
C. 足少阳胆经
D. 手少阳三焦经
E. 手太阳小肠经

正确答案：D。手少阳三焦经

解析：该题考查十二经脉与脏腑器官的联络。足太阳膀胱经起于目内眦，至耳上角，入络脑（A错）。足阳明胃经起于鼻，入上齿，环口夹唇，循喉咙（B错）。足少阳胆脉，起于目锐眦，下耳后，入耳中，出耳前（C错）。手少阳三焦经系耳后，出耳上角，入耳中，至目锐眦（D对）。手太阳小肠经 ，至目内外眦，入耳中，抵鼻（E错）。记忆：表1-2，这个表非常重要，要牢记经脉与哪些器官联络